下列各项，不出现潮式呼吸的是
A. 脑干损伤
B. 颅内压增高
C. 脑炎
D. 代谢性酸中毒
E. 脑膜炎

正确答案：D。代谢性酸中毒

解析：潮式呼吸机制是由于呼吸中枢的兴奋性降低，使呼吸的反馈系统失常。只有缺氧严重，二氧化碳潴留到一定程度时，才能刺激呼吸中枢，促使呼吸恢复和加强；当二氧化碳呼出后，呼吸中枢又失去有效的兴奋性，使呼吸又再次减弱进而暂停。而代谢性酸中毒（D错，为正确答案）时可刺激呼吸中枢，使呼吸加深加快，通过肺脏排出二氧化碳进行代偿，以调节酸碱平衡，这种深长的呼吸称为库斯莫尔（Kussmual）呼吸。脑炎（Ｃ对）、脑膜炎（Ｅ对）、颅内压增高（Ｂ对）及某些中毒，如糖尿病酮中毒、巴比妥中毒等可出现潮式呼吸。脑干损伤（A对）是呼吸中枢受损，可降低对二氧化碳反应性，因此可出现潮式呼吸。